对控制慢性肾脏病变肾功能进行性减退无明确作用的措施是
A. 限制蛋白质的摄入
B. 减少蛋白尿
C. 控制血压
D. 消除浮肿
E. 纠正血脂异常

正确答案：D。消除浮肿

解析：去除导致肾功能恶化的因素，为控制慢性肾脏病变肾功能进行性减退的有效措施，可以保护肾功能和延缓慢性肾脏病变进展。其中，限制蛋白质的摄入（A对）可以减少肾小球的滤过，减少蛋白尿，延缓肾脏病变进展；减少蛋白尿（B对）、控制血压（C对），可以保护靶器官免受损害；纠正血脂异常（E对）可以减轻甘油三酯、HDL等对肾脏血管的损伤，均可以保护肾功能，延缓病变进展。消除浮肿（D错，为本题正确答案）只是一般性的对症治疗，对控制慢性肾脏病变肾功能进行性减退无明确作用。